治疗呼吸衰竭气阴两虚，痰热扰心证，应首选
A. 六君子汤合导痰汤
B. 圣愈汤合涤痰汤
C. 生脉散合黄连温胆汤
D. 保元汤合温胆汤
E. 肾气丸合涤痰汤

正确答案：C。生脉散合黄连温胆汤

解析：呼吸衰竭气阴两虚，痰热扰心证治宜益气养阴，清热化痰；选用益气生津，敛阴止汗的生脉散和清热燥湿，理气化痰的黄连温胆汤加减（C对）。六君子汤合导痰汤功用益气健脾，除湿化痰适用于呼吸衰竭脾肺气虚，湿痰蒙蔽证（A错）。圣愈汤补气、补血、摄血联合豁痰开窍的涤痰汤适用于气虚亏虚，痰浊瘀闭之证（B错）。保元汤养血安神，补血安胎，除热生津，温胆汤理气化痰，二者合用适用于血虚痰凝之证（D错）。肾气丸有补肾助阳之功效合用豁痰开窍的涤痰汤适用于肾阳不足，痰浊瘀闭之证（E错）。